下列关于胆汁的描述，正确的是
A. 非消化期无胆汁分泌
B. 消化期只有胆囊胆汁排入小肠
C. 胆汁中含有脂肪消化酶
D. 胆汁中与消化有关的成分是胆盐
E. 胆盐可促进蛋白质的消化和吸收

正确答案：D。胆汁中与消化有关的成分是胆盐